治疗中风中经络肝肾阴虚，风阳上扰证，应首选
A. 镇肝息风汤
B. 天麻钩藤饮
C. 星蒌承气汤
D. 二陈汤合桃红四物汤
E. 补阳还五汤

正确答案：A。镇肝息风汤

解析：镇肝息风汤可以育阴潜阳，镇肝息风，用于治疗中风中经络肝肾阴虚，风阳上扰证（A对）。天麻钩藤饮（B错）可平肝潜阳，活血通络，用于肝阳暴亢，风阳上扰证。星蒌承气汤（C错）可通腑泻热，化痰理气，用于痰热腑实，风痰上扰证。二陈汤合桃红四物汤（D错）用于痰凝血瘀证。补阳还五汤可益气活血，化瘀通络，（E错）用于气虚血瘀证。